房水产生于
A. 虹膜
B. 晶状体
C. 睫状体
D. 玻璃体
E. 巩膜静脉窦

正确答案：C。睫状体

解析：房水产生于睫状体（C对）。